关于孟鲁司特钠临床使用注意事项的说法正确的是
A. 孟鲁司特钠起效快，适用于哮喘急性发作
B. 孟鲁司特钠可单独用于哮喘治疗
C. 孟鲁司特钠使用后可能会导致嗜酸性粒细胞增多
D. 12岁以下儿童禁用孟鲁司特钠
E. 孟鲁司特钠对阿司匹林诱发的哮喘无效

正确答案：C。孟鲁司特钠使用后可能会导致嗜酸性粒细胞增多

解析：本题考查孟鲁司特钠临床使用注意事项。孟鲁司特钠使用后可能会导致嗜酸性粒细胞增多（C对）。孟鲁司特钠为白三烯受体阻断剂，常见的不良反应除嗜酸性粒细胞增多外还有血管炎性皮疹、心肺系统异常或末梢神经异常。在治疗急性哮喘上，白三烯受体阻断剂疗效尚未确定，不宜应用于急性发作的治疗（A错）或解除哮喘急性发作时的支气管痉挛。孟鲁司特一般不单独用于哮喘治疗（B错）。孟鲁司特的用法用量：口服：成人及15岁以上儿童：一次10mg，一日1次。6～14岁儿童：一次5mg，一日1次。2～5岁儿童：一次4mg，一日1次，睡前服用咀嚼片（D错）。对哮喘尤其是对阿司匹林敏感的哮喘，孟鲁司特能减少发作次数和症状（E错）。